糖尿病病人多尿属于
A. 水利尿
B. 渗透性利尿
C. 尿崩症
D. 尿失禁
E. 尿潴留

正确答案：B。渗透性利尿